空腹听诊出现振水音，可见于
A. 肝硬化腹水
B. 肾病综合征
C. 结核性腹膜炎
D. 幽门梗阻
E. 急性肠炎

正确答案：D。幽门梗阻

解析：当胃内有多量液体及气体存留时可出现振水音。检查时患者仰卧，医生以一耳凑近上腹部，同时以冲击触诊法振动胃部，即可听到气、液撞击的声音，亦可将听诊器膜型体件置于上腹部进行听诊，正常人在餐后或饮进多量液体时也可有上腹部振水音，但若在空腹仍有此音，则提示幽门梗阻（D对）或胃扩张。肝硬化腹水（A错）可见移动性浊音阳性。肾病综合征（B错）较少出现腹部体征。结核性腹膜炎（C错）触诊腹部可出现柔韧感，是粘连型结核性腹膜炎的临床特征，绝大多数患者均有不同程度的压痛，一般较轻微，少数压痛明显并有反跳痛，后者多见于干酪型。急性肠炎（E错）是细菌、病毒、真菌和寄生虫等引起的小肠炎和结肠炎，恶心、呕吐、腹泻是急性肠炎的主要症状，查体可见脐周或下腹部轻度压痛、肠鸣音亢进。